大面积烧伤病人易出现
A. 低渗性脱水
B. 等渗性脱水
C. 高渗性脱水
D. 等容量性低钠血症
E. 等容量性高钠血症

正确答案：B。等渗性脱水

解析：大面积烧伤病人由于大量丢失等渗性液体，可造成等渗性脱水（B对）。若只补充水分而未补充电解质，则可造成低渗性脱水（A错）。